下列不属于微循环缺血期的主要临床表现的是：
A. 脸色苍白，四肢冷汗
B. 烦躁不安
C. 脉搏细速
D. 出汗
E. 神志淡漠、昏迷

正确答案：E。神志淡漠、昏迷

解析：休克早期即微循环缺血期，此期患者表现为脸色苍白，四肢湿冷（A对），出冷汗（D对），脉搏细数（C对），脉压减小，尿量减少，烦躁不安（B对）。由于血液的重新分配，心、脑灌流量此时仍可维持正常。因此，患者在休克代偿期间神志一般是清楚的，但常显得烦躁不安（图13-4)。该期患者血压可骤降（如大失血），也可略降，甚至因代偿作用可正常或轻度升高，但是脉压会明显缩小，患者脏器有效灌流量明显减少。神志淡漠、昏迷（E错，为本题正确答案）不属于微循环缺血期的主要临床表现。